2013版DRIs提出，我国居民植物固醇的SPL为
A. 0.4mg/d
B. 0.6mg/d
C. 0.9g/d
D. 1.5mg/d
E. 10mg/d

正确答案：C。0.9g/d